当感知过的事物重新出现在眼前时。能够识别出来，这是
A. 回忆
B. 识记
C. 遗忘
D. 再认
E. 保持

正确答案：D。再认